继发性痛经伴月经失调常见的疾病是
A. 卵巢囊肿
B. 子宫肌瘤
C. 子宫内膜异位症
D. 多囊卵巢综合征
E. 功血

正确答案：C。子宫内膜异位症

解析：子宫内膜异位症的症状为继发性痛经和下腹痛、月经异常、性交痛、不孕等（C对）；卵巢囊肿通常无症状，也可出现下腹不适、腹围增大、腹部包块、腹痛、阴道异常出血等（A错）；子宫肌瘤的症状：肿瘤较小者无明显症状，较大者可有痛经和月经改变等（B错）；多囊卵巢综合征的症状：月经失调、不孕、毛发多、肥胖等（D错）；无规律地子宫出血的症状：无规律地子宫出血，血量时多时少，或突然增多（E错）。